男，30岁，近半年出现尿频、尿不净及肛周隐痛不适，多次检查尿常规WBC1～3/HP，前列腺液常规，WBC＞10个/HP，卵磷脂小体（+++）/HP。前列腺液培养阴性，血常规无异常。该患者的诊断应为
A. 慢性膀胱炎
B. 泌尿系结核
C. 非淋菌性尿道炎
D. 慢性前列腺炎
E. 膀胱结石

正确答案：D。慢性前列腺炎

解析：青年男性患者，近半年出现尿频、尿不尽及肛周隐痛不适（慢性前列腺炎表现），多次检查尿常规WBC1～3/HP，前列腺液常规，WBC＞10个/HP，卵磷脂小体（+++）/HP（慢性前列腺炎特征性表现）。该患者的诊断应为慢性前列腺炎（D对）。慢性膀胱炎一般反复发作或持续存在尿频、尿急、尿痛，并有耻骨上膀胱区不适，膀胱充盈时疼痛较明显，尿液混浊（A错）。泌尿系结核一般有低热、盗汗等结核毒血症状（B错）。非淋菌性尿道炎表现为尿道刺痒、尿痛和分泌少量白色稀薄液体，有时仅为痂膜封口或裤裆污秽，常见于晨间（C错）。膀胱结石典型症状为排尿突然中断，疼痛放射至远端尿道及阴茎头部，伴排尿困难和膀胱刺激症状（E错）。